人体降钙素来源于
A. 甲状腺滤泡旁细胞
B. 甲状腺滤泡上皮细胞
C. 甲状旁腺主细胞
D. 成骨细胞
E. 破骨细胞

正确答案：A。甲状腺滤泡旁细胞

解析：降钙素（CT）是由甲状腺滤泡旁细胞分泌（A对），主要靶器官是骨和肾，具有降低血钙和血磷的作用。甲状腺滤泡上皮细胞是甲状腺激素的合成部位（B错）：甲状旁腺主细胞合成的是甲状旁腺激素（PTH）（C错）。甲状旁腺激素可直接或间接作用于成骨细胞（D错）和破骨细胞（E错），升高血钙降低血磷。